某男，60岁。患慢性支气管炎近10年。近日因感风寒病情加重。症见恶寒发热，无汗，咳喘痰稀。医师诊为咳喘，证属风寒水饮，处以功能解表化饮、止咳平喘的小青龙胶囊。该胶囊的处方组成有麻黄、桂枝、干姜、细辛、五味子、白芍、法半夏、炙甘草。药后诸症缓解。方中所用法半夏长于祛寒痰，应选用的炮制辅料是
A. 生姜与白矾
B. 甘草与白矾
C. 甘草与生姜
D. 甘草与生石灰
E. 白矾与生石灰

正确答案：D。甘草与生石灰

解析：本题考查的是法半夏的炮制辅料。方中法半夏偏于祛寒痰，常用的炮制辅料是甘草与生石灰（D对）。半夏：【炮制方法】处方用名有生半夏、清半夏、姜半夏、法半夏。①生半夏：取原药材，除去杂质，洗净，干燥，用时捣碎。②清半夏：取净半夏，大小分开，用8%白矾溶液浸泡至内无干心，口尝微有麻舌感，取出，洗净，切厚片，干燥。每100kg净半夏，用白矾20kg（BE错）。③姜半夏：取净半夏，大小分开，用水浸泡至内无干心，取出，另取生姜切片煎汤，加白矾与半夏共煮至透心，取出，晾干，或晾至半干，干燥；或切薄片，干燥。每100kg净半夏，用生姜25kg，白矾12.5kg（AC错）。④法半夏：取净半夏，大小分开，用水浸泡至内无干心，取出，另取甘草适量，加水煎煮二次，合并煎液，倒入用适量石灰水配制的石灰液中，搅匀，加入上述已浸透的半夏，浸泡，每日搅拌1～2次，并保持浸液pH在12以上，至切面黄色均匀，口尝微有麻舌感时，取出，洗净，阴干或烘干。每100kg净半夏，用甘草15kg，生石灰10kg。